喹诺酮类药物的作用特点是
A. 抗菌谱广，抗菌力强
B. 口服吸收好，组织浓度高
C. 不良反应少
D. 与其它药物有交叉耐药性
E. 有较长PAE

正确答案：A、B、C、E。抗菌谱广，抗菌力强；口服吸收好，组织浓度高；不良反应少；有较长PAE

解析：本题考查喹诺酮类药物的作用特点。喹诺酮类药物抗菌谱广、抗菌作用强（A对），既用于需氧菌感染，也可用于厌氧菌感染。该类药物还具有抗生素作用后效应（E对），使用药间隔延长。该类药物口服吸收好，体内分布广，在多数组织体液中药物浓度高于血浆浓度（B对），且不良反应少（C对），与其它药物无交叉耐药性（D错）。